不同企业生产一种药物不同制剂，处方和生产工艺可能不同，欲评价不同制剂间吸收速度和程度是否相同，应采用评价方法是
A. 生物等效性试验
B. 微生物限度检查法
C. 血浆蛋白结合率测定法
D. 平均滞留时间比较法
E. 制剂稳定性试验

正确答案：A。生物等效性试验

解析：本题考查生物等效性。生物等效性试验（A对）是指一种药物的不同制剂在相同试验条件下，给以相同剂量，反应其吸收程度和速度的主要药动学参数无统计学差异，不同企业生产一种药物的不同制剂，处方和生产工艺可能不同，当给予相同剂量时，可以采用生物等效性来评价不同制剂间吸收速度和程度；微生物限度检查法（B错）系检查非规定灭菌制剂及其原料、辅料受微生物污染程度的方法；血浆蛋白结合率（C错）是药物进入人体后,与血浆中的白蛋白结合的数量,占全部药物总量的百分比；平均滞留时间（D错）是指静注后所有药物分子滞留在体内的平均时间；制剂稳定性实验（E错）是指考察原料药或者药物制剂在温度，湿度，光线等影响下随时间变化规律的试验方法。